西洋参所含的化学成分有
A. 人参皂苷Rf
B. 人参皂苷Rb₁
C. 人参皂苷Rg₁
D. 假人参皂苷F₁₁
E. 人参皂苷Re

正确答案：A、B、C、D、E。人参皂苷Rf；人参皂苷Rb₁；人参皂苷Rg₁；假人参皂苷F₁₁；人参皂苷Re

解析：本题考查的是西洋参的成分。西洋参所含的化学成分有人参皂苷Rf（A对）、人参皂苷Rb₁（B对）、人参皂苷Rg₁（C对）、假人参皂苷F₁₁（D对）、人参皂苷Re（E对）。西洋参【成分】含人参皂苷类成分，已分离出人参皂苷R₀、Rb₁、Rb₂、Rb₃，、Rc、Rd、RA₀、Re、Rf、Rg₁、Rg₂、Rg₃、Rh₁、Rh₂、F₃及西洋参皂苷L₁和假人参皂苷F₁₁。